相对浓度升高时可加速氧化磷酸化的物质是
A. NADP+
B. ADP
C. NADPH
D. UTP
E. FAD

正确答案：B。ADP

解析：氧化磷酸化又称电子传递链，经线粒体氧化呼吸链电子传递释放的能量驱动ADP磷酸化生成ATP，在此过程中ADP是反应的底物之一，当ATP/ADP的比值降低、ADP（B对）的相对浓度升高可加速氧化磷酸化。NADPH主要由磷酸戊糖途径生成，NADPH/NADP＋（AC错）主要调节磷酸戊糖途径的流量。UTP（D错）不直接参与氧化磷酸化，其浓度升高对氧化磷酸化无明显作用。FAD（E错）是氧化磷酸化中的复合体Ⅱ的辅酶，对反应速率的影响远小于反应底物。